不协调性子宫收缩乏力的恰当处理应是
A. 针刺合谷三阴交穴位
B. 温肥皂水灌肠
C. 肌注哌替啶
D. 人工破膜
E. 静脉滴注缩宫素

正确答案：C。肌注哌替啶

解析：不协调性宫缩乏力的处理原则是调节子宫收缩，恢复正常节律性和极性。肌注哌替啶（C对），使产妇充分休息，醒后不协调性宫缩多能恢复为协调性宫缩。温肥皂水灌肠（B错）用于润滑肠道，缓解便秘等症状。人工破膜（P189）（D错）主要用于协调性宫缩乏力宫口扩张≥3cm、无头盆不称、胎头已衔接而产程延缓者。静脉滴注缩宫素（P189）（E错）适用于协调性宫缩乏力、宫口扩张≥3cm、胎心良好、胎位正常、头盆相称者，在宫缩恢复协调性之前，严禁应用缩宫素。针刺合谷三阴交穴位（A错）主要用于治疗痛经。